HLA复合体共有224个基因座位，其中
A. 功能性基因128个、假基因96个
B. 功能性基因100个、假基因96个
C. 功能性基因98个、假基因96个
D. 功能性基因96个、假基因96个
E. 功能性基因68个、假基因96个

正确答案：A。功能性基因128个、假基因96个

解析：HLA复合体的定位和结构：HLA复合体位于第6号染色体短臂，全长3600kb，共有224个基因座位，其中128个为功能性基因，96个为假基因。掌握“HLA种类及其产物、医学意义”知识点。